患者，男，23岁恶寒，发热，鼻塞声重，流清涕，头痛，咳嗽，口不渴，舌苔薄白，脉浮紧其治法是
A. 清暑解表
B. 益气解表
C. 滋阴解表
D. 辛温解表
E. 辛凉解表

正确答案：D。辛温解表

解析：本题患者为感冒，风寒外束，腠理闭塞，肺气失宣。风寒之邪外束肌表，卫阳被郁，故见恶寒、发热。清阳不展，络脉失和则头痛。风寒上受，肺气不宣，鼻窍不利而致鼻塞流涕、咳嗽。寒为阴邪则口不渴。舌苔薄白，脉浮紧，俱为风寒在表之征象，所以治法宜用辛温解表（D对）；清暑解表的适用于暑湿伤表证，症见身热，微恶风，汗少，肢体酸重或疼痛，头昏重胀痛，咳嗽痰黏，鼻流浊涕，心烦口渴，渴不多饮，口中黏腻，胸脱痞闷，泛恶，小便短赤，舌苔薄黄而腻，脉濡数（A错）；益气解表用于气虚外感证，症见声重，咳嗽有痰，胸膈痞满，舌淡苔白，脉浮而按之无力（B错）；滋阴解表用于阴虚外感证，症见心痛身热、微恶风寒、无汗或有汗不多、咳嗽心烦、口渴咽干、舌赤脉数（C错）；辛凉解表用于风热犯肺证，症见身热较著，微恶风寒，汗出不畅，头胀痛，目胀，鼻塞，流浊涕，口干而渴，咳嗽，痰黄黏稠，咽燥，或咽喉肿痛，舌苔薄白微黄，边尖红，脉浮数（E错）。